需要避光并低温保存的药品是
A. 板蓝根颗粒
B. 氨茶碱注射液
C. 氯化钠注射液
D. 氯化钾注射液
E. 巴曲酶注射液

正确答案：E。巴曲酶注射液

解析：本题考查药品的贮存。巴曲酶注射液（E对）需要避光并低温保存。板蓝根颗粒（A错）在潮湿环境中极易吸潮、结块，故应防潮保管。氨茶碱注射液（B错）在光线照射下易变质，故需避光保存于阴凉干燥处。氯化钠注射液（C错）和氯化钾注射液（D错）密封保存即可。